对甲类传染病病人的接触者所采取的措施是
A. 留验
B. 医学观察
C. 应急接种
D. 隔离

正确答案：A。留验

解析：本题考查对甲类传染病病人的接触者所采取的措施。对甲类传染病病人的接触者所采取的措施是留验（A对BCD错），即限制其活动范围，并要求在指定场所进行诊察、检验和治疗。